医学道德保密的作用中提法不正确的是
A. 体现了患者对医务人员的无比信任
B. 体现了医务人员对病人人格和权利的尊重
C. 有利于保护医务人员个人的权利
D. 有利于医护工作的开展和医护质量的提高
E. 可以避免因泄密而给病人带来危害和发生医患纠纷

正确答案：C。有利于保护医务人员个人的权利

解析：医学道德保密是指医务人员在医护活动中应当具有对医疗和护理保守秘密的职业道德品质。本题选择错误选项：医学道德保密作用如下：（1）体现了患者对医务人员的无比信任（A对）。（2）体现了医务人员对病人人格和权利的尊重（B对）。（3）有利于建立良好的医患关系。（4）有利于医护工作的开展和医护质量的提高（D对）。（5）可以避免因泄密而给病人带来危害和发生医患纠纷（E对）（C错，为本题正确答案）。